强迫症的核心症状为
A. 强迫行为
B. 强迫意向
C. 强迫表象
D. 强迫性恐惧
E. 强迫观念

正确答案：E。强迫观念

解析：强迫症的临床症状为强迫观念和强迫行为，以强迫观念为核心症状，最为常见（E对）。强迫动作是一再出现的重复或刻板的行为，常继发于强迫观念，是强迫症的症状之一，但不是核心症状（A错）。强迫意向是强迫观念的症状之一，但不是强迫症的核心症状（B错）。